关于复合固定桥，下列叙述哪项是错误的
A. 一般包括4个或4个以上的牙单位
B. 取得共同就位道比较困难
C. 各基牙受力均匀，不易松动脱落
D. 由2种或2种以上的简单固定桥组合而成
E. 以上均是

正确答案：C。各基牙受力均匀，不易松动脱落

解析：本题考查复合固定桥。复合固定桥中，由于各基牙生理动度方向不同，彼此之间存在角度，故各基牙受力不均，长时间如此易引起受力方向的牙槽骨吸收，最终导致基牙的松动甚至脱落（C错，为本题的正确答案）。复合固定桥由2种或2种以上的简单固定桥组合而成（D对）。有2个以上基牙，一般包括4个或4个以上的牙单位（A对）。由于基牙数量多且可能有中间基牙的存在，而每个基牙的倾斜方向和角度有所不同，故取得共同就位道比较困难（B对）。